地面水自净作用中最重要、最活跃的方式是
A. 物理化学净化过程
B. 化学净化过程
C. 生物净化过程
D. 物理净化过程
E. 水生生物净化过程

正确答案：C。生物净化过程

解析：本题考查生物净化过程。地面水自净作用中最重要、最活跃的方式是生物净化过程（C对ABDE错）。生物净化过程是指在河流、湖泊、水库等水体中生存的细菌、真菌、藻类、水草、原生动物、贝类、昆虫、幼虫、鱼类等生物，通过它们的代谢作用分解水中污染物，使其数量减少，直至消失。